在DNA双螺旋中，两链间碱基配对形成氢键，其配对关系是
A. T＝A、C≡G
B. G≡A、C≡T
C. U＝A、C≡G
D. U＝T、T＝A
E. C＝U、G≡A

正确答案：A。T＝A、C≡G